根据藏医理论，赤巴为
A. 水
B. 火
C. 土
D. 空
E. 风

正确答案：B。火

解析：本题考查的是藏医的三因学说。根据藏医理论，赤巴为火（B对）。藏医的三因学说：三因即隆、赤巴、培根三种因素。三因学说以三种因素的属性、功能、生克制约关系解释人体生理、病理及治疗机制等医学内容。三因源于五元，“隆”与五元中的“风（E错）”相同；“赤巴”为火；“培根”，“培”为水（A错），“根”为土（C错），与水、土两元相同。三因素依次大体相当于中医的气、火、津液。但藏医所说的三因具有生理和病理两方面的概念。空（D错）属于五元。五元即土、水、火、风、空五种物质元素。藏族古代宗教哲学认为，土、水、火、风、空是一切器世界（宇宙万物）和情世界（人和生物）产生的本源，是构成世界万物的基础元素，故亦称五元或五大。